振奋精神增加供氧能力的兴奋剂
A. 呋塞米
B. 甲睾酮
C. 哌替啶
D. 苯丙胺
E. 哌唑嗪

正确答案：D。苯丙胺

解析：本题考查兴奋剂的分类。苯丙胺（D对）属于兴奋剂中的精神刺激药，这类兴奋剂对神经肌肉的药理作用才是真正的“兴奋作用”，振奋精神增加供氧能力。呋塞米（A错）为利尿剂。甲睾酮（B错）为蛋白同化制剂（合成类固醇）。哌替啶（C错）为麻醉止痛剂。哌唑嗪（E错）不属于兴奋剂。